男，65岁。逐渐出现语速迟缓、语量减少、口语不流利和找词困难，但能理解家人和医生的指令。受损可能性最大的部位是
A. 中央后回的下部
B. 中央前回的上部
C. 中央旁小叶的前部
D. 额下回的后部
E. 缘上回的上部

正确答案：D。额下回的后部

解析：患者语速迟缓、语量减少、口语不流利和找词困难，但能理解家人和医生的指令。考虑为Broca失语。受损可能性最大的部位是额下回的后部（D对）。